下列哪项不是附骨疽的临床特点
A. 好发于儿童
B. 多发于脊柱骨
C. 局部胖肿，疼痛彻骨
D. 溃后脓水淋漓，不易收口
E. 可成窦道，损筋伤骨

正确答案：B。多发于脊柱骨

解析：附骨疽是一种毒气深沉、附着于骨的化脓性疾病。相当于西医的急、慢性化脓性骨髓炎。附骨疽好发于四肢长骨，部位以胫骨为多，其次是股骨、肱骨、尺桡骨，少见于脊柱骨（B对）。附骨疽好发于气血未充、骨骼柔弱的小儿，尤以10岁以下男孩为多见（A错）。附骨疽主要由外感六淫之邪化火生毒、湿热毒邪乘虚而入及外伤后复感毒邪、瘀血化热引起，导致火热邪毒内生，气血壅滞不畅，凝滞于筋骨，不通则痛，出现局部胖肿，疼痛彻骨（C错）。热盛肉腐而为脓，同时患者体质多为气血不足、肾精耗竭、骨髓空虚之人，易出现溃后脓水淋漓，不易收口，可成窦道，损筋伤骨（DE错）。